急性严重的锥体束损害的断联休克表现为
A. 痉挛性瘫，腱反射消失
B. 痉挛性瘫，腱反射亢进
C. 弛缓性瘫，腱反射亢进
D. 弛缓性瘫，腱反射消失
E. 完全性瘫，腱反射存在

正确答案：D。弛缓性瘫，腱反射消失

解析：急性严重的锥体束损害的断联休克是指中枢神经系统局部急性严重病变，引起功能上与受损部位密切联系的远隔部位神经功能短暂缺失。如急性中枢性偏瘫，肢体开始表现为弛缓性瘫，腱反射消失（D对）、肌张力减低（脑休克）。休克期过去后，受损组织的释放症状逐渐出现，转变为痉挛性瘫，腱反射亢进（B错），肌张力增高，病理反射阳性。ACE均为不符合急性严重的锥体束损害的断联休克表现。另外需要了解的是，在皮质下白质及内囊处，锥体束病变引起的偏瘫，常常是上肢比下肢重，远端比近端重，上肢伸肌比屈肌重，下肢的屈肌比伸肌重。